男，45岁。体检发现空腹血糖8mmol/L，餐后2h血糖13mmol/L，血清甘油三酯3.5mmol/L，低密度酯蛋白胆固醇3.6mmol/L。无明显不适，半年内体重下降10kg。查体：BP160/100mmHg，BMI28，心肺查体无阳性发现。降血压首选的治疗药物是
A. α受体阻滞剂
B. 血管紧张素转化酶抑制剂
C. 钙通道阻滞剂
D. 利尿剂
E. β受体阻滞剂

正确答案：B。血管紧张素转化酶抑制剂

解析：患者中年男性，体检发现空腹血糖8，餐后2H血糖13，根据糖尿病诊断标准可知，患者患有糖尿病。查体：BP160/100，收缩压和舒张压均提示该患者为高血压2级。综上所诉，患者可诊断为糖尿病伴高血压2级。对于高血压合并糖尿病的患者降血压首选的治疗药物是血管紧张素转化酶抑制剂（ACEI）（B对）。ACEI可抑制交感-肾素-血管紧张素-醛固酮系统，扩张外周血管而降低血压；还可改善胰岛素抵抗、减少尿蛋白形成，因此特别适合于高血压合并糖尿病的患者。用于抗高血压治疗的α受体阻滞剂（A错）主要为α₁受体阻滞剂，如哌唑嗪、特拉唑嗪等，因其副作用较多，目前不主张单独使用（P255）。钙通道阻滞剂（P255）（C错）对血脂、血糖等无明显影响，而患者血清甘油三酯增高（正常值0.56～1.70mmol/L），低密度酯蛋白胆固醇轻度增高（正常值≤3.12mmol/L），故其不能作为本例首选。利尿剂（D错）可使血脂、血糖、血尿酸升高，β受体阻滞剂（E错）能增加胰岛素抵抗，还可能掩盖和延长低血糖反应（P253），两者都不适合用于高血压合并糖尿病的患者。